妇康宁片除调经养血外，又能
A. 调经舒郁
B. 活血调经
C. 调经止带
D. 除烦安神
E. 理气止痛

正确答案：E。理气止痛

解析：本题考查的是妇康宁片的功能。妇康宁片除调经养血外，又能理气止痛（E对）。妇康宁片【功能】调经养血，理气止痛。定坤丹【功能】滋补气血，调经舒郁（A错）。益母草颗粒（膏、胶囊、片、口服液）【功能】活血调经（B错）。乌鸡白凤丸（片）【功能】补气养血，调经止带（C错）。更年安片（胶囊）【功能】滋阴清热，除烦安神（D错）。